根管扩大的标准主锉一般应比初尖锉至少大
A. 1号
B. 2号
C. 3号
D. 4号
E. 5号

正确答案：B。2号

解析：本题考查髓腔进入与初预备。根管扩大的标准主锉一般应比初尖锉至少大。根管扩大的标准主锉一般应比初尖锉至少大2号（B对），便于彻底清除根管内的感染物并利于根管充填。